口服给药的外文缩写是
A. im.
B. i.h.
C. iv.
D. iv gtt
E. po.

正确答案：E。po.

解析：本题考查处方中常见的外文缩写及其含义。医师在书写处方正文时会采用拉丁文缩写或者英文缩写表示，其中po.（E对）缩写含义为口服。im.（A错）缩写含义为肌内注射。i.h.（B错）缩写含义为皮下的（尤指皮下注射）。iv.（C错）缩写含义为静脉注射。iv gtt（D错）缩写含义为静脉滴注。